地尔硫䓬化学结构中有2个手性碳原子，其光学异构体个数是
A. 3
B. 4
C. 5
D. 6
E. 2

正确答案：B。4

解析：本题考查地尔硫䓬的光学异构体。地尔硫䓬分子结构中有两个手性碳原子，具有四个（B对）立体异构体，即反式D-异构体和反式L-异构体，以及顺式D-异构体和顺式L-异构体。